以下关于CPI检查指数牙的描述，不恰当的是
A. 20岁以上者需要检查以下10颗指数牙
B. 20岁以上者检查牙龈出血、牙石和牙周袋情况
C. 15岁以下者，检查6颗指数牙
D. 20岁以下，15岁以上者，检查8颗指数牙
E. 15岁以下者检查牙龈出血和牙石情况，不检查牙周袋深度

正确答案：D。20岁以下，15岁以上者，检查8颗指数牙

解析：20岁以下，15岁以上者，为避免第二恒磨牙萌出过程中产生的假性牙周袋，只检查6颗指数牙。掌握“牙周病流行病学及分级预防”知识点。